《中华人民共和国药品管理法》对劣药的规定是
A. 药品成分的含量与药品标准规定不符合的
B. 超过有效期的
C. 变质不能用药的
D. 被污染不能用药的
E. 未取得批准文号生产的

正确答案：A、B。药品成分的含量与药品标准规定不符合的；超过有效期的

解析：本题考查劣药。根据《药品管理法》第九十八条第三款规定，有下列情形之一的，为劣药：①药品成分的含量不符合国家药品标准（A对）；②被污染的药品；③未标明或者更改有效期的药品；④未注明或者更改产品批号的药品；⑤超过有效期的药品（B对）；⑥擅自添加防腐剂、辅料的药品；⑦其他不符合药品标准的药品。《药品管理法》第九十八条第一款、第二款规定，禁止生产（包括配制，下同）、销售、使用假药。有下列情形之一的，为假药：①药品所含成分与国家药品标准规定的成分不符的；②以非药品冒充药品或者以他种药品冒充此种药品的。有下列情形之一的药品，按假药论处：①国务院药品监督管理部门规定禁止使用的；②依照本法必须批准而未经批准生产、进口，或者依照本法必须检验而未检验即销售的；③变质的（C错）；④被污染的（D错）；⑤使用依照本法必须取得批准文号而未取得批准文号的原料药生产的（E错）；⑥所表明的适应症或者功能主治超出规定范围的。